儿童重症肌无力的临床特点是
A. 严重全身肌无力
B. 易发生延髓肌瘫痪
C. 局限于四肢肌无力
D. 多局限于眼外肌瘫痪
E. 易发生重症肌无力危象

正确答案：D。多局限于眼外肌瘫痪

解析：重症肌无力（MG）是免疫介导的神经肌肉接头处传递障碍的慢性疾病，临床上以骨骼肌运动上极易疲劳并导致肌无力，休息或用胆碱酯酶抑制剂后症状减轻为特征。儿童重症肌无力眼肌型最多见，多局限于眼外肌瘫痪（D对），早晨轻，起床后逐渐加重，反复用力做睁闭眼动作也使症状更明显，不易发生重症肌无力危象（E错），肌无力危象是指因治疗延误或措施不当使重症肌无力本身病情加重，可因呼吸肌无力而呼吸衰竭。全身型主要表现为运动后局限于四肢肌无力（C错），严重者卧床难起，呼吸机无力时危及生命。新生儿暂时性重症肌无力可能出现严重全身肌无力（A错），严重者需要机械呼吸或鼻饲。进行性延髓瘫痪易发生延髓肌瘫痪（B错）。